胸导管阻塞或破裂所致的胸腔积液为
A. 漏出液
B. 渗出液
C. 脓性胸液
D. 血性胸液
E. 乳糜性胸液

正确答案：E。乳糜性胸液

解析：胸腔积液分为渗出液和漏出液两种。漏出液（P330）（A错）是非炎性积液，主要形成原因是血浆胶体渗压降低、毛细血管流体静压升高、淋巴管阻塞等。渗出液为炎性积液，主要原因有感染、外伤、化学刺激、肿瘤、风湿等，可表现为脓性胸液、血性胸液和乳糜性胸液等。脓性胸液（P330）（C错）常见于金黄色葡萄球菌等化脓性细菌感染。血性胸液（P330）（D错）见于创伤、外科手术、脓胸、结核感染等。乳糜性胸液（P330）（E对B错）常是由于胸导管受压或浸润，见于肿瘤和结核等。